胃肠道穿孔的X线表现
A. 小肠扩张，大量积气积液
B. 两膈下可见新月形透亮气体影
C. 内积气
D. 结肠内可见气体
E. 腹部均致密，腰大肌清晰

正确答案：B。两膈下可见新月形透亮气体影

解析：胃肠道穿孔X线表现为膈下游离气体，表现为双侧膈下线条状或新月状透光影，边界清楚，上缘为光滑整齐的膈肌，下缘分别为肝、脾上缘（B对E错）。小肠机械性肠梗阻的X线表现小肠扩张，大量积气积液（A错）。两膈下可见新月形透亮气体影见于胃肠道穿孔。肠内积气是功能性的疾病，是胃肠蠕动慢或者脾胃虚弱，容易受凉导致的（CD错）。